高动力型休克和低动力型休克均见于
A. 感染性休克
B. 创伤性休克
C. 过敏性休克
D. 失血性休克
E. 烧伤性休克

正确答案：A。感染性休克

解析：感染性休克（A对）即脓毒性休克，按其血流动力学变化可分为高动力型休克和低动力型休克，高动力型休克指病原体或其毒素侵入机体后，引起高代谢和高动力循环状态，即出现发热、心排出益增加、外周阻力降低、脉压增大等临床特点，又称为高排低阻型休克或暖休克。低动力型休克具有心排出量减少、外周阻力增高、脉压明显缩小等特点，又称低排高阻型休克或称冷休克。创伤性休克（B错）、过敏性休克（C错）、失血性休克（D错）和烧伤性休克（E错）无分型。